幼儿膳食应遵循平衡膳食的原则，三种供能营养素蛋白质、脂肪与碳水化合物供能比例分别为
A. 8%、30%、62%
B. 10%、20%、70%
C. 15%、20%、65%
D. 15%、30%、55%
E. 20%、20%、60%

正确答案：D。15%、30%、55%

解析：本题考查宏量营养素供能比例。安排的膳食应满足小儿每日所需的热能及各种营养素。营养素的供应应当保持稳定不可忽高忽低；各种营养素之间的比例也要合理。三种供能营养素能量分配以总的供热中蛋白质占15%、脂肪占30%、碳水化合物占55%（D对ABCE错）为宜，其中脂肪的摄入不宜过多，以免引起肥胖。